与西地那非合用，可导致严重低血压的药品是
A. 硝酸甘油
B. 甲睾酮
C. 非那雄胺
D. 丙酸睾酮
E. 克拉霉素

正确答案：A。硝酸甘油

解析：本题考查硝酸甘油的不良反应。与西地那非合用，可导致严重低血压的药品是硝酸甘油（A对）。西地那非属5型磷酸二脂酶抑制剂，硝酸酯类药是NO自由基的供体，可以激活鸟苷酸环化酶，使GPT环化产生cGMP，升高组织中cGMP的浓度，后者通过降低血管平滑肌中的Ca²⁺，导致血管舒张。